流感病毒发生变异的形式有
A. 抗原转移、抗原漂移
B. 抗原转移、抗原转换
C. 抗原转换、抗原替换
D. 抗原替换、抗原转移
E. 抗原转换、抗原漂移

正确答案：E。抗原转换、抗原漂移

解析：甲型流感病毒易发生抗原变异，抗原变异有两种形式：抗原转换、抗原漂移（E对）。抗原漂移变异幅度小，属量变，这种规模可引起中小型规模的流行。抗原转换变异幅度大，形成新亚型，由于人群对新亚型流感病毒缺乏免疫力，往往引发大流行。